克罗恩病的主要手术指征是
A. 营养不良、体重减轻
B. 严重腹泻
C. 持续性粪隐血阳性
D. 疑有恶变
E. 合并结肠息肉

正确答案：D。疑有恶变

解析：克罗恩病的主要手术指征包括疑有恶变（D对），肠梗阻、狭窄，慢性肠穿孔后形成腹腔脓肿、肠内瘘或肠外瘘，肛周病变，长期持续出血以及内科治疗无效者等。营养不良体重减轻（A错）、严重腹泻（B错）、持续性粪隐血阳性（C错）、合并结肠息肉（E错）可行内科保守治疗，一般不需要手术。